在梦中将内心所爱或恨的几个对象，凝缩成一个形象表现出来的是
A. 象征
B. 移置
C. 凝缩
D. 投射
E. 变形

正确答案：C。凝缩

解析：凝缩：指在梦中将内心所爱或恨的几个对象，凝缩成一个形象表现出来。掌握“心理治疗原则、主要方法及应用”知识点。